某村猪群食用变质粮食后，生长缓慢，食量下降，体重较轻，母畜不孕，产仔减少，死后肝脏发现再生结节，其原因可能为
A. 赤霉病麦中毒
B. 伏马菌素中毒
C. 黄曲霉毒素中毒
D. 亚硝酸盐中毒
E. 苯并（a）芘中毒

正确答案：C。黄曲霉毒素中毒

解析：本题考查黄曲霉毒素中毒。黄曲霉是我国粮食中常见的真菌，黄曲霉毒素中毒的慢性毒性主要表现为动物生长障碍，肝脏出现亚急性或慢性损伤，肝功能降低，肝实质细胞坏死、变性、胆管上皮增生、形成结节，出现肝硬化。其他症状表现为体重减轻、生长发育迟缓、食物利用率下降、母畜不孕或产仔减少等。根据该村猪群的症状，可判断其原因可能为黄曲霉毒素中毒（C对ABDE错）。